功能泻火除烦，善于清泻三焦火邪的药物是
A. 栀子
B. 决明子
C. 金银花
D. 夏枯草
E. 芦根

正确答案：A。栀子

解析：该题考查清热药的归经、功效及应用。题中均为药性寒凉药物，能清热泻火，但栀子泻火除烦，入心、肺、三焦经，能清泻三焦火邪（A对）。决明子、金银花、夏枯草无除烦之功效（BCD错）。芦根可泻火除烦，甘、寒，入肺、胃经，可清肺胃实热，不能清三焦火邪（E错）。